障眼明片除能退翳明目外，又能
A. 疏散风热
B. 清肝泻火
C. 补益肝肾
D. 清热散风
E. 养血疏肝

正确答案：C。补益肝肾

解析：本题考查障眼明片的功能。障眼明片除能退翳明目外，又能补益肝肾（C对）。障眼明片【功能】补益肝肾，退翳明目。清咽滴丸【功能】疏风清热（A错），解毒利咽。耳聋丸【功能】清肝泻火（B错），利湿通窍。明目蒺藜丸【功能】清热散风（D错），明目退翳。妇科十味片【功能】养血舒肝（E错），调经止痛。